最能体现不伤害原则的是
A. 医生为患者选用疗效相当但价格低廉的药物
B. 医生为患者提供完全、真实的信息，供其选择表态
C. 医生使用艾滋病患者病情资料时，应作隐去姓名等处理
D. 医生诊断时应考虑患者的各方面因素
E. 医生治疗时应努力使患者受益

正确答案：A。医生为患者选用疗效相当但价格低廉的药物